下列哪种不是HLA复合体的遗传特征
A. 多克隆性
B. 基因常需要重组
C. 共显性遗传
D. 单元型遗传
E. 连锁不平衡

正确答案：B。基因常需要重组